细菌已侵入、繁殖并引起急性炎症、坏死、化脓的创口属于
A. 无菌创口
B. 污染创口
C. 感染创口
D. 一期愈合创口
E. 延期愈合创口

正确答案：C。感染创口

解析：本题考查口外创口处理。凡细菌已经侵入、繁殖并引起急性炎症、坏死、化脓的创口和在此情况下进行手术的创口均为感染创口（C对）。